在医患交往过程中，医护人员不恰当的交往方式是
A. 重视患者的自我感受
B. 采取封闭和开放式的提问
C. 用专业术语进行交流
D. 关注疾病本身和相关话题
E. 了解患者的安全需要

正确答案：C。用专业术语进行交流

解析：医患沟通的基本方法有选择正确的沟通形式、选择恰当的沟通场所、使用沟通技巧。沟通技巧常用的沟通技巧包括：（1）尊重，接纳患者：（2）聆听与共情能力：耐心而认真地聆听患者的陈述，对患者的陈述予以恰当的回应，表达理解，设身处地地体验到患者的病痛和疾苦并表达同感，重视患者的自我感受（A对），了解患者的安全需求（E对）：（3）明确的沟通目标，围绕沟通目标提问，采取封闭和开放式提问（B对）：（4）控制沟通中的信息：有效的沟通需要传递与沟通目标相关的信息，双方就此信息交换意见，表达态度、情感和解决方案。不要偏离了目标，提供与目标无关的信息（D对）：（5）把握沟通的语言、语调和语速：沟通中语言要简练、清晰，通俗、易于理解，不要充满医学术语让患者费解（C错，为本题正确答案）：（6）尽可能符合患者的文化背景：（7）确认彼此是否信任真诚。